组织病理学能够分为“JTOF”和“JPOF”两种组织学亚型的与骨相关的牙源性肿瘤是
A. 牙瘤
B. 成釉细胞纤维瘤
C. 骨化纤维瘤
D. 正中囊肿
E. 腺样囊性癌

正确答案：C。骨化纤维瘤

解析：骨化纤维瘤是一种边界清楚、由富于细胞的纤维组织和表现多样的矿化组织构成的病变。青少年小梁状骨化纤维瘤（JTOF）和青少年沙瘤样骨化纤维瘤（JPOF）为骨化纤维瘤的两种组织学变异型。掌握“骨化纤维瘤”知识点。